女，70岁，风湿性心脏瓣膜病20年。因心悸5天就诊。查体：自动体位，BP150/70mmHg，心率119次/分，心律绝对不齐，心音强弱不等。心电图示：心房颤动。宜首选的抗凝治疗是
A. 华法林
B. 阿司匹林
C. 肝素
D. 尿激酶
E. 复方丹参片

正确答案：A。华法林

解析：房颤合并瓣膜病患者，首选的抗凝治疗是华法林（A对）。非瓣膜病患者需使用CHA₂DS₂-VASc评分法对患者进行危险分层。CHA₂DS₂-VASc评分法的评分标准为：充血性心力衰竭/左心室功能障碍（1分）；高血压（1分）；年龄≥75岁（2分）；糖尿病（1分）；脑卒中/TIA/血栓栓塞史（2分）；血管疾病（1分）；年龄65~74岁（1分）；性别女性（1分）。CHA₂DS₂-VASc评分≥2，需抗凝治疗；评分1分者，根据获益与风险权衡，优选抗凝治疗；评分为0分者，无需抗凝治疗。肝素（P190）（C错）抗凝起效快，主要用于房颤紧急复律治疗。尿激酶（D错）为溶栓药，不能当作抗凝药使用。复方丹参片（E错）为中成药，具有活血化瘀，理气止痛的功效，多用于治疗冠心病心绞痛。